一碳单位代谢的辅酶是
A. 叶酸
B. 二氢叶酸
C. 四氢叶酸
D. NADPH
E. NADH

正确答案：C。四氢叶酸

解析：一碳单位是指某些氨基酸在分解代谢过程中产生的含有一个碳原子的基团，包括甲基（-CH₃）、甲烯基（-CH₂-）、甲炔基（-CH=）、甲酰基（-CHO）及亚氨甲基（-CH=NH）等。一碳单位代谢的辅酶是四氢叶酸（C对），一碳单位不能游离存在，常与四氢叶酸结合而转运和参与代谢。